下列常出现血沉明显增快的情况，应除外
A. 结核病
B. 心绞痛
C. 心肌梗死
D. 慢性肾炎
E. 多发性骨髓瘤

正确答案：B。心绞痛

解析：血沉，即红细胞沉降率，是指红细胞在一定条件下沉降的速率，它主要受血浆中各种蛋白的比例的影响而改变。病理性增快主要见于：1）各种炎症性疾病，如风湿热、结核病（A对）时，因纤维蛋白原及免疫球蛋白增加，血沉明显加快；2）组织损伤及坏死如急性心肌梗死（C对）时血沉加快，而心绞痛（B错，为本题正确答案）时无改变，这是因为急性心肌梗死时，心肌酶释放入血，诱发炎性反应，导致血浆蛋白成份改变，血沉增快，而心绞痛仅为心肌缺血，尚未出现心肌细胞死亡；3）恶性肿瘤等；4）各种原因导致血浆球蛋白相对或绝对增高，如慢性肾炎（D对）、多发性骨髓瘤（E对）等。